McBurney点
A. 左、右髂前上棘连线的右、中1/3交界点
B. 右髂前上棘与脐连线的中、内1/3交界点
C. 右髂前上棘与脐连线的中、外1/3交界点
D. 右腹股沟韧带的中、内1/3交界点
E. 右腹股沟韧带的中、外1/3交界点

正确答案：C。右髂前上棘与脐连线的中、外1/3交界点

解析：Mcburney点位于右髂前上棘与脐连线的中、外1/3交点处(C对)。